前磨牙中颊舌尖的高度、大小相近的是
A. 上颌第一前磨牙
B. 上颌第二前磨牙
C. 下颌第一前磨牙
D. 下颌第二前磨牙
E. 上颌第一磨牙

正确答案：B。上颌第二前磨牙

解析：本题考查牙体解剖外形。前磨牙中颊舌尖的高度、大小相近的是上颌第二前磨牙（B对），上颌第二前磨牙颊面颈部较上颌第一前磨牙宽，颊尖圆钝，偏近中，舌面与颊面大小相似或略小，舌尖圆钝，偏近中。上颌第一前磨牙（A错）颊尖长大锐利，舌尖较短小圆钝。下颌第一前磨牙（C错）颊尖长大而舌尖特短小。下颌第二前磨牙（D错）如只有一个舌尖，舌面则较颊尖小。上颌第一磨牙（E错）（牙合）面有近中颊尖、远中颊尖、近中舌尖和远中舌尖四个牙尖，其中近中舌尖最大，其次是近中颊尖、远中颊尖，远中舌尖最小。